右心衰竭主要是由于
A. 心率加快
B. 体循环静脉淤血
C. 毛细血管通透性增高
D. 肺淤血、肺水肿
E. 心室肥厚

正确答案：B。体循环静脉淤血

解析：心力衰竭是由于各种原因的心机损伤和（或）心脏负荷过重，引起心肌结构和功能的变化，最后导致心室泵血和（或）充盈功能低下，造成一系列临床表现的综合征。体循环静脉瘀血，主动脉压升高，右心室后负荷增加，导致右心衰竭（B对）。心率加快，心舒期明显缩短，心腔血量减少，前负荷减小，不是引起心力衰竭的病因（A错）。毛细血管通透性增高时，既可以导致左心衰竭，又可以导致右心衰竭（C错）。肺瘀血、肺水肿时，肺动脉压升高，左心室后负荷增加，导致左心衰竭（D错）。心室肥厚是心力衰竭的代偿期反应，不是病因（E错）。